男，55岁。上腹疼痛8小时。进食高脂餐并饮酒后出现上腹痛，呕吐2次后疼痛无缓解。查体：T37.8℃，巩膜轻度黄染，心肺未见异常，上腹偏左压痛、反跳痛阳性。最可能的诊断是
A. 急性心肌梗死
B. 急性胰腺炎
C. 肠梗阻
D. 急性胃炎
E. 急性胆嚢炎

正确答案：B。急性胰腺炎

解析：中年男性患者，进食高脂餐并饮酒后上腹持续疼痛8小时、呕吐2次后疼痛无缓解（饮酒、进食高脂餐是急性胰腺炎的常见诱因，急性腹痛、吐后疼痛不缓解为急性胰腺炎的典型症状）。查体：T37.8℃，上腹偏左压痛、反跳痛阳性（腹膜刺激征为急性胰腺炎的常见体征）。综合患者的病史、临床表现，可初步诊断为急性胰腺炎（B对）。急性心肌梗死（九版内科学P235）（A错）主要表现为发作性心前区疼痛，患者常有胸闷或濒死感，偶可表现为上腹痛，但不会出现压痛、反跳痛（腹膜刺激征）等体征。肠梗阻（P358）（C错）主要表现为腹痛、呕吐、腹胀、停止排气排便，一般与进食无关。急性胃炎（九版内科学P353）（D错）常表现为腹痛、腹胀、恶心、呕吐等，但一般无压痛、反跳痛等腹膜刺激征。急性胆囊炎（P443）（E错）常表现为进食油腻饮食后右上腹阵发性绞痛，右上腹腹膜刺激征，Murphy征阳性。